对于大多数的牙周炎患者，维护期复诊间隔不宜超过
A. 3个月
B. 6个月
C. 8个月
D. 10个月
E. 12个月

正确答案：B。6个月

解析：牙周治疗结束后随即应该进入到“维护阶段”，也成“牙周支持治疗阶段”。在牙周的维护期间，对于大多数牙周炎患者，复诊的间隔不宜超过6个月。掌握“牙周病流行病学及分级预防”知识点。